血小板计数正常值参考范围是
A. （10～50）×10⁹/L
B. （50～100）×10⁹/L
C. （100～300）×10⁹/L
D. （300～500）×10⁹/L
E. （500～700）×10⁹/L

正确答案：C。（100～300）×10⁹/L

解析：本题属于血小板计数的参考值。血小板计数正常值参考范围是（100～300）×10⁹/L（C对）。血小板主要作用有：①对毛细血管的营养和支持作用；②通过黏附、聚集与释放反应，在伤口处形成白色血栓而止血；③产生多种血小板因子，参与血液凝固，形成血栓而进一步止血；④释放血小板收缩蛋白使纤维蛋白网发生退缩，促进血液凝固。血小板在一日内的不同时间可相差6%～10%。参考值：（100～300）×10⁹/L。